叶细小鳞片状，交互对生，贴伏于枝上，深绿色或黄绿色的药材是
A. 枇杷叶
B. 大青叶
C. 番泻叶
D. 罗布麻叶
E. 侧柏叶

正确答案：E。侧柏叶

解析：本题考查的是侧柏叶药材的性状鉴别。叶细小鳞片状，交互对生，贴伏于枝上，淡绿色或黄绿色的药材是侧柏叶（E对）。侧柏叶：【性状鉴别】药材多分枝，小枝扁平。叶细小鳞片状，交互对生，贴伏于枝上，深绿色或黄绿色。质脆，易折断。气清香，味苦涩、微辛。枇杷叶（A错）：【性状鉴别】药材呈长椭圆形或倒卵形。先端尖，基部楔形，边缘上部有疏锯齿，近基部全缘。上表面灰绿色、黄棕色或红棕色，较光滑；下表面密被黄色绒毛，主脉于下表面显著突起，侧脉羽状；叶柄极短，被棕黄色绒毛。革质而脆、易折断。气微、味微苦。大青叶（B错）：【性状鉴别】药材多皱缩卷曲，有的破碎。完整的叶片展平后呈长椭圆形至长圆状倒披针形；上表面暗灰绿色，有的可见色较深稍突起的小点；先端钝，全缘或微波状，基部狭窄下延至叶柄呈翼状；叶柄淡棕黄色。质脆。气微，味微酸、苦、涩。番泻叶（C错）：【性状鉴别】药材狭叶番泻呈长卵形或卵状披针形，叶端急尖，叶基稍不对称，全缘。上表面黄绿色，下表面浅黄绿色，无毛或近无毛，叶脉稍隆起。革质。气微弱而特异，味微苦，稍有黏性。罗布麻叶（D错）：【性状鉴别】药材多皱缩卷曲，有的破碎，完整叶片展平后呈椭圆状披针形或卵圆状披针形，淡绿色或灰绿色，先端钝，有小芒尖，基部钝圆或楔形，边缘具细齿，常反卷，两面无毛，叶脉于下表面突起；叶柄细。质脆，气微，味淡。